正常人每日唾液总量为
A. 500～800ml
B. 800～1000ml
C. 1000～1500ml
D. 1500～1800ml
E. 1800～2000ml

正确答案：C。1000～1500ml

解析：正常人每日唾液总量为1000～1500ml。掌握“口外一般检查及辅助检查”知识点。